某男性患者，29岁。因车祸发生腹股沟处大量出血，现场医务工作者应该采取的止血方法是
A. 压迫止血
B. 包扎止血
C. 结扎止血
D. 填塞止血
E. 缝扎止血

正确答案：A。压迫止血

解析：本题考查止血方法。某男性患者，29岁。因车祸发生腹股沟处大量出血，应考虑为股动脉损伤出血，现场医务工作者应该采取的止血方法是压迫止血（A对）。包扎止血（B错）最为常用，主要用于一般小动脉和静脉损伤出血。结扎止血（C错）是用止血钳将出血点结扎止血，一般需在手术室进行。填塞止血（D错）主要用于肌肉、骨端等渗血止血。缝扎止血（E错）适用于较大血管或重要部位血管出血，一般需在手术室进行。